逍遥散与一贯煎相同的功用是
A. 和营
B. 益气
C. 滋阴
D. 疏肝
E. 补脾

正确答案：D。疏肝

解析：本题考查逍遥散与一贯煎功用的相同点。逍遥散功用疏肝解郁，养血健脾，主治肝郁血虚脾弱证。一贯煎功用滋阴疏肝，主治肝肾阴虚，肝气郁滞证。二者都具疏肝理气的作用，均可治肝郁气滞之胁痛（D对）。逍遥散不具有和营，滋阴的作用（AC错）。一贯煎不具有益气，补脾的作用（BE错）。